既滋阴润肺，又补脾益气的是
A. 石斛
B. 黄精
C. 百合
D. 北沙参
E. 枸杞子

正确答案：B。黄精

解析：本题考查的是黄精的功效。既滋阴润肺，又补脾益气的是黄精（B对）。黄精：【功效】滋阴润肺，补脾益气。石斛（A错）：【功效】养胃生津，滋阴除热，明目，强腰。百合（C错）：【功效】养阴润肺，清心安神。北沙参（D错）：【功效】养阴清肺，益胃生津。枸杞子（E错）：【功效】滋补肝肾，明目，润肺。